目前临床上最常采用的牙种植体为
A. 骨内种植体
B. 牙内骨内种植体
C. 骨膜下种植体
D. 黏膜下种植体
E. 以上都不是

正确答案：A。骨内种植体

解析：本题考查种植体。目前临床上最常采用的牙种植体为骨内种植体（A对）。骨内种植体是指种植体位于颌骨内，提高了骨表面的结合强度，固位好，是临床上最常采用的牙种植体。牙内骨内种植体适用于牙周炎松动牙的固定、外伤性松动牙的固定、牙齿根尖切除术后的固定以及调整根冠比例，适用范围有一定的局限性（B错）。骨膜下种植体适用于牙槽嵴宽度和高度不够而又难以采用其他骨内种植体来达到功能效果者（C错）。黏膜下种植体位于黏膜下，维持其稳固的组织结构少，固位力支持力差，很少用（D错）。